发生在肝生化转化第二阶段的是
A. 葡萄糖醛酸结合反应
B. 氧化反应
C. 还原反应
D. 水解反应
E. 脂化反应

正确答案：A。葡萄糖醛酸结合反应